性微温，专于降气祛痰止咳的药是
A. 白前
B. 百部
C. 前胡
D. 芥子
E. 洋金花

正确答案：A。白前

解析：本题考查的是白前的功效。性微温，专于降气祛痰止咳的药是白前（A对）。白前：【功效】降气祛痰止咳。百部（B错）：【功效】润肺止咳，杀虫灭虱。前胡（C错）：【功效】降气祛痰，宣散风热。芥子（D错）：【功效】温肺祛痰，利气散结，通络止痛。洋金花（E错）：【功效】平喘止咳，解痉，定痛。